我国卫生部规定，一名供精者的精子最多只能提供给
A. 8名妇女受孕
B. 6名妇女受孕
C. 15名妇女受孕
D. 5名妇女受孕
E. 10名妇女受孕

正确答案：D。5名妇女受孕

解析：我国辅助生殖技术应用伦理准则规定，为了保护后代，同一供者的精子、卵子最多只能使5名妇女受孕（D对）。